下列肺结核类型中，传染性最强的是
A. 慢性纤维空洞型肺结核
B. 干酪性肺炎
C. 原发性肺结核
D. 急性血行播散型肺结核
E. 慢性血行播散型肺结核

正确答案：A。慢性纤维空洞型肺结核

解析：传染性肺结核患者排菌是结核传播的主要来源，原发性肺结核（C错）、慢性血行播散型肺结核（E错）两者痰中含菌量均很少，因此传染性不强。急性血行播散型肺结核（D错）虽然起病急，持续高热，中毒症状严重，痰中结核杆菌的数量不多，故传染性也不强。干酪性肺炎痰中虽然能查出结核分枝杆菌，但传染性没有慢性纤维空洞型肺结核强（B错）。慢性纤维空洞型肺结核痰结核分枝杆菌长期检查阳性且常耐药（A对），故其传染性最强。。